对胃十二指肠黏膜损害最严重的药物是
A. 保泰松
B. 非甾体类抗炎药
C. 肝素
D. 消炎痛
E. 水杨酸

正确答案：D。消炎痛

解析：非甾体类抗炎药（NSAIDs）（B错）分为非选择性COX抑制药和选择性COX-2抑制药，前者胃肠道反应常见，后者胃肠道反应轻微，但增加了心血管系统不良反应隐患。非选择性COX抑制药按化学结构，分为水杨酸类（如阿司匹林）、苯胺类、吲哚类（如吲哚美辛即消炎痛）、芳基乙酸类、芳基丙酸类、烯醇酸类、吡唑酮类（如保泰松）、烷酮类、异丁芬酸类等。水杨酸、保泰松、消炎痛均可引起上腹不适、恶心、呕吐、腹痛、腹泻、消化道溃疡及出血等，但消炎痛还可引起穿孔，对胃十二指肠黏膜损害最严重（D对AE错）。肝素（C错）是抗凝药，主要不良反应是出血。